眉间至后发际正中的骨度分寸是
A. 15寸
B. 16寸
C. 12寸
D. 13寸
E. 14寸

正确答案：A。15寸

解析：根据骨度分寸量表，眉间至前发际正中为3寸，前发际正中至后发际正中为12寸，所以眉间至后发际正中为15寸（A对）。